清热药可分为
A. 清热泻火药
B. 清退虚热药
C. 清热凉血药
D. 清热燥湿药
E. 清热解毒药

正确答案：A、B、C、D、E。清热泻火药；清退虚热药；清热凉血药；清热燥湿药；清热解毒药

解析：本题考查的是清热药的分类。清热药可分为清热泻火药（A对）、清退虚热药（B对）、清热凉血药（C对）、清热燥湿药（D对）与清热解毒药（E对）。凡药性寒凉，以清解里热为主要功效的药物，称为清热药。按其性能功效及临床应用，常将本类药物分为清热泻火药、清热燥湿药、清热凉血药、清热解毒药、清虚热药五类。